下列各项，不支持艾滋病诊断的是
A. 口咽念珠菌感染
B. 持续发热
C. 头痛，进行性痴呆
D. 皮肤黏膜出血
E. 慢性腹泻

正确答案：D。皮肤黏膜出血

解析：艾滋病期 有流行病学史，实验室检查 HIV抗体阳性，符合下列各项任意一项即可诊断：原因不明的不规则发热（B对），体温高于38℃1个月以上；慢性腹泻（>3次/日），持续一个月以上（E对）；体重在6个月内下降10%上；反复发作的口腔念珠菌（假丝酵母菌）感染（A对）；反复发作的单纯疱疹、带状疱疹病毒感染；卡氏肺孢子菌肺炎；反复发生的细菌性肺炎；活动性结核或肺结核分枝杆菌病；深部真菌感染；中枢神经系统占位性病变；中青年人出现痴呆（C对）；活动性巨细胞病毒感染；弓形虫病；马尔尼菲青霉菌感染；反复发作的败血症；皮肤黏膜或内脏的卡波西肉瘤、淋巴瘤（D错，为本题正确答案）。